治疗剂量与中毒剂量相近的药物
A. 毒性药品
B. 麻醉药品
C. 放射性药品
D. 局部麻醉药品
E. 精神药品

正确答案：A。毒性药品

解析：本题考查毒性药品。医疗用毒性药品（简称毒性药品）（A对）是指毒性剧烈，治疗剂量与中毒剂量相近，使用不当会致人中毒或死亡的药品。麻醉药品（B错）是指连续使用后易产生身体依赖性、能成瘾癖的药品。放射性药品（C错）是指用于临床诊断或者治疗的放射性核素制剂或者其标记化合物。局部麻醉药品（D错）是一类能在用药局部可逆性的阻断感觉神经冲动发生与传递的药品，简称“局麻药”。精神药品（E错）是指直接作用于中枢神经系统，使之兴奋或抑制，连续使用可产生依赖性的药品。